（牙合）龈距离短，咬合力大者修复最佳选用
A. 嵌体
B. 部分冠
C. 桩核冠
D. 塑料全冠
E. 铸造金属全冠

正确答案：E。铸造金属全冠

解析：本题考查牙体缺损修复体固位及适应、禁忌证。铸造金属全冠（E对）用于（牙合）龈距离短、牙体小、轴壁缺损大、对（牙合）牙为自然牙、患者（牙合）力大、牙周支持组织差者。